下列不属于前瞻性队列研究的特点的是
A. 可直接计算发病率
B. 多数情况下要计算发病密度
C. 多用于稀有疾病
D. 每次调查能同时研究几种疾病
E. 因素可分为几个等级，以便计算剂量-反应关系

正确答案：C。多用于稀有疾病

解析：本题考查前瞻性队列研究的特点。前瞻性队列研究的特点有：①可直接计算发病率（A对）；②多数情况下要计算发病密度（B对）；③每次调查能同时研究几种疾病（D对）；④因素可分为几个等级，以便计算剂量-反应关系（E对）。前瞻性队列研究不适于发病率很低的疾病的病因研究，因为在这种情况下需要的研究对象数量太大，一般难以达到。因此，多用于稀有疾病（C错，为本题正确答案）不属于前瞻性研究的特点。